属于慢性肉芽肿性炎的是
A. 结核
B. 伤寒
C. 肠阿米巴病
D. 慢性支气管炎
E. 慢性阑尾炎

正确答案：A。结核

解析：慢性肉芽肿性炎是以肉芽肿形成为特征的特殊类型慢性炎症，包括结核（A对）、麻风、梅毒等。伤寒（P358）（B错）是由伤寒杆菌引起的急性增生性炎，虽然其特征性病变是伤寒肉芽肿，但伤寒肉芽肿的形成是急性过程。肠阿米巴病（P369）（C错）属于变质性炎。慢性支气管炎（P169）（D错）、慢性阑尾炎（E错）属于慢性非特异性炎。